急性化脓性颌骨骨髓炎病理表现为
A. 见大量的中性粒细胞浸润
B. 病变区骨小梁的成骨活性降低
C. 骨髓组织高度充血和炎症性水肿
D. 骨髓腔以化脓性渗出物和坏死物质充满
E. 以上说法均正确

正确答案：E。以上说法均正确

解析：本题考查急慢性化脓性颌骨骨髓炎。病理表现为骨髓组织高度充血和炎症性水肿（C对），并见大量的中性粒细胞浸润（A对）；且随炎症的进展，组织溶解坏死，骨髓腔以化脓性渗出物和坏死物质充满（D对），形成脓肿；病变区骨小梁的成骨活性降低（B对），破骨活性增高；残存于脓肿内或坏死组织内的海绵状骨小梁，由于失去血供而导致成骨细胞和骨细胞的完全消失，形成死骨，其周围有炎性肉芽组织。综上，以上说法均正确（E对，为本题正确答案）。